对皮脂腺分泌过多的寻常痤疮者可以选用的药品是
A. 过氧化苯甲酰凝胶
B. 替硝唑片剂
C. 维胺酯胶囊
D. 红霉素-过氧苯甲酰凝胶
E. 维A酸乳膏剂

正确答案：A。过氧化苯甲酰凝胶

解析：本题考查痤疮治疗药。对皮脂腺分泌过多的寻常痤疮者可以选用的药品是过氧苯甲酰凝胶（A对）。对皮脂腺分泌过多所致的寻常型痤疮，首选2.5%～10%过氧化苯甲酰凝胶涂敷患部，一日1～2次。替硝唑片剂（B错）属于硝基咪唑类抗菌药，不用于痤疮治疗。维胺酯胶囊（C错）用于具有调节和控制上皮细胞分化与生长，抑制角化，抑制痤疮丙酸菌生长的作用，对其有效。红霉素-过氧化苯甲酰凝胶（D错）主要用于中、重度痤疮合并细菌感染显著患者。维A酸乳膏剂（E错）主要用于炎症突出的寻常痤疮者。